肿疡期常用
A. 膏药
B. 油膏
C. 箍围药
D. 掺药
E. 洗剂

正确答案：B。油膏

解析：油膏是将药物与油类煎熬或捣匀成膏的制剂，现称软膏。在应用上，其优点有柔软、滑润、无板硬黏着不舒的感觉，尤其对病灶的凹陷折缝之处或大面积的溃疡，使用油膏更为适宜、故近代常用油膏来代替膏药。适用于肿疡、溃疡、皮肤病糜烂结痂渗液不多者，以及肛门病等（B对）。膏药适应一切外科疾病初起、成脓、溃后各个阶段（A错）。箍围药适应凡外疡不论初起、成脓及溃后，肿势散漫不聚而无集中之硬块者（C错）。掺药应用范围很广，不论肿疡和溃疡等均可应用。其他如皮肤病、肛门病等也可以施用（D错）。洗剂用于急性、过敏性皮肤病，如酒脑鼻和粉刺等（E错）。